《中国药典》（一部）规定，金银花中需测定含量的成分有
A. 绿原酸
B. 芳樟醇
C. 木樨草苷
D. 双花醇
E. 肌醇

正确答案：A、C。绿原酸；木樨草苷

解析：本题考查的是金银花含量测定。《中国药典》（一部）规定，金银花中需测定含量的成分有绿原酸（A对）、木樨草苷（C对）。金银花【含量测定】按《中国药典》采用高效液相色谱法测定，本品含绿原酸不得少于1.5%；含木犀草苷不得少于0.050%。【成分】忍冬花蕾含黄酮类，为木犀草素及木犀草苷、忍冬苷、金丝桃苷。并含肌醇（E错）、绿原酸、异绿原酸、皂苷及挥发油。油中主含双花醇（D错）、芳樟醇（B错）等。现已证明金银花的抗菌有效成分以绿原酸和异绿原酸为主。